两个正态双变量资料，自变量记为X，因变量记为Y，进行回归分析，回归系数为0.2，经统计学检验，P＝0.05，则
A. X增大一个单位，Y增大0.2个单位
B. X增大一个单位，Y减少0.5个单位
C. X增大一个单位，Y增大0.05个单位
D. X增大一个单位，Y减少0.2个单位
E. X增大一个单位，Y减少或增大0.2个单位都有可能

正确答案：A。X增大一个单位，Y增大0.2个单位

解析：P=0.05说明经假设检验，X与Y之间呈直线回归关系，回归方程为Y=a+bX，回归系数为0.2，即斜率b=0.2，则Y与X之间是递增的直线回归关系，即Y随着X的增大而线性增大。则X增大一个单位，Y增大0.2个单位（A对）。